表面麻醉常用的药物是
A. 0.25%～0.5%普鲁卡因
B. 0.25%～0.5%利多卡因
C. 0.25%～0.5%盐酸丁卡因
D. 1%～2%普鲁卡因
E. 4%～5%利多卡因

正确答案：C。0.25%～0.5%盐酸丁卡因

解析：表面麻醉临床应用较多的是2%～5%利多卡因和0.25%～0.5%的盐酸丁卡因。也可采用6%～20%的苯佐卡因或1%的盐酸达克罗宁行表面麻醉，但其麻醉作用不及丁卡因。掌握“颌面部常用局麻法及牙拔除的麻醉选择”知识点。